子宫内膜异位症根治手术适用于
A. 45岁以上重度患者
B. 45岁以下轻度患者
C. 45岁以上轻度患者
D. 45岁以下重度患者
E. 45岁以下中度患者

正确答案：A。45岁以上重度患者

解析：子宫内膜异位症根治手术是将子宫、双附件及盆腔内所有异位内膜病灶予以切除和清除，适用于45岁以上重度患者（A对）。